乙酰胺可以用于解救
A. 有机氟农药中毒
B. 有机磷农药中毒
C. 有机硫农药中毒
D. 灭鼠药中毒
E. 有机氯农药中毒

正确答案：A。有机氟农药中毒

解析：本题考查乙酰胺。乙酰胺可以用于解救有机氟农药中毒（A对）。乙酰胺（解氟灵）是氟乙酰胺中毒的特殊解毒药。有机磷农药中毒（B错）的解毒剂是阿托品和解磷定。灭鼠药中毒（D错）的特效解毒剂是维生素K₁。